分子中含有一个手性碳为选择性心脏β₁受体激动剂药物是
A. 沙丁胺醇
B. 盐酸克仑特罗
C. 盐酸多巴胺
D. 沙美特罗
E. 盐酸多巴酚丁胺

正确答案：E。盐酸多巴酚丁胺

解析：本题考查多巴酚丁胺。盐酸多巴酚丁胺（E对）分子中含有一个手性碳原子，并且为选择性心脏β₁受体激动剂，用于对多巴胺无效或不能耐受的急性心衰。沙丁胺醇（A错）、盐酸克伦特罗（B错）均为选择性β₂受体激动剂，主要用作平喘药物。盐酸多巴胺（C错）为选择性β₁受体激动剂，但是分子中没有手性碳原子。沙美特罗（D错）为β₂受体激动剂，为长效平喘药物。